患者，男，21岁。呼吸困难，咳嗽，汗出1小时而就诊。查体：端坐呼吸，呼吸急促，口唇微绀，心率114次/分，律齐，双肺满布哮鸣音。为迅速缓解症状，应立即釆取的最佳治法是
A. 口服氨荼碱
B. 肌注氨茶碱
C. 喷吸沙丁胺醇
D. 口服泼尼松
E. 肌注阿托品

正确答案：C。喷吸沙丁胺醇

解析：沙丁胺醇为缓解气道症状的药物，喷吸沙丁胺醇（C对）能够迅速缓解呼吸困难、喘息、咳嗽的症状，同时减少了口服给药引起全身副作用。茶碱（A错）是常用的支气管扩张药，临床可用于支气管哮喘、慢性阻塞性肺病、中枢性睡眠呼吸暂停综合征，但起效慢，作用不及沙丁胺醇，一般情况下不宜采用，主要用于慢性哮喘的维持治疗，以防止急性发作。氨茶碱（B错）在急性重度哮喘或哮喘持续状态时可采用氨茶碱静脉注射或静脉滴注，以迅速缓解喘息与呼吸困难等症状。泼尼松（D错）为糖皮质激素类药物，长期应用糖皮质激素能够缓解气道炎症，改善患者肺功能，降低气道高反应性，降低发作的频率和程度，改善症状，提高生活质量，但由于副作用较大，一般采用吸入给药的方式避免全身副作用，一般不用于缓解急性呼吸症状。阿托品（E错）为非选择性M胆碱受体阻断药，对全身组织的各型M胆碱受体产生阻断作用，副作用多，不用于哮喘以及呼吸道急促症状的治疗。